男性，45岁，6年来经常腹胀，下肢浮肿，面部有蜘蛛痣，腹水（﹢），肝未触及，脾肋缘下lcm，应诊断为
A. 慢性肝炎
B. 慢性肝淤血
C. 酒精性肝炎
D. 门脉性肝硬化
E. 肝癌

正确答案：D。门脉性肝硬化

解析：中年男性患者，6年来经常腹胀，下肢浮肿，面部有蜘蛛痣，腹水（﹢），肝未触及，脾肋缘下lcm。有腹水、脾肿大，是肝硬化失代偿期门脉高压症的典型表现，脾肿大、侧枝循环的建立和开放、腹水示门静脉高压症的三大临床表现（D对）。慢性肝炎早期症状轻微，可见恶心，腹胀，黄疸，常有病毒感染、饮酒、服用肝毒性药物等病因，少数治疗不当后期可发展为肝硬化（A错）。慢性肝淤血是充血性心力衰竭和缩窄性心包炎最常见的并发症，临床常见肝脏体积增大，质地较坚韧且有触痛（B错）。酒精性肝炎是由于长期大量饮酒导致的肝脏疾病，其主要临床表现为恶心、呕吐、黄疸，可有肝肿大和压痛（C错）。肝癌早期无特异性症状，中晚期可见肝区疼痛、腹胀、纳差、乏力、消瘦，进行性敢打或上腹部包块等表现（E错）。